患者，男，50岁。喉中痰鸣如吼，胸高胁胀，痰黄黏稠，咯吐不利，烦闷不安，面赤汗出，舌红苔黄，脉弦滑。治疗应首选
A. 定喘汤
B. 射干麻黄汤
C. 三子养亲汤
D. 苏子降气汤
E. 葶苈大枣泻肺汤

正确答案：A。定喘汤

解析：题中患者以喉中痰鸣如吼为主症，故诊断为哮病。痰热壅肺，肺失清肃，肺气上冲，故喉中痰鸣如吼，胸高胁胀；热蒸炼液成痰，痰热胶结，故痰黄黏稠，咯吐不利；痰火郁蒸，故烦闷不安，面赤汗出；舌红苔黄，脉弦滑为痰热内盛之象，故辨为热哮证，治宜清热宣肺，化痰定喘，首选定喘汤或越脾加半夏汤（A对）。射干麻黄汤功能温肺化饮，止哮平喘，为哮病冷哮证的选方（B错）。三子养亲汤功能涤痰利窍，降气平喘，为哮病风痰哮的选方（C错）。苏子降气汤功能降气平喘，祛痰止咳，主治上实下虚喘咳证（D错）。葶苈大枣泻肺汤功能泻肺行水，下气平喘，主治痰水壅实之咳喘胸满，多用于饮证的治疗（E错）。